女，72岁。摔伤右髋部，既往全身情况良好。查体：右下肢缩短，外旋畸形，下肢轴向叩击痛阳性。首选的检查方法是
A. X线片
B. 核素扫描
C. 关节造影
D. MRI
E. CT

正确答案：A。X线片

解析：老年女性患者，有摔伤史，右下肢缩短、外旋畸形（提示可能为股骨颈骨折），下肢轴向叩击痛阳性，结合患者病史、临床表现及体查结果，该患者最可能的诊断为右侧股骨颈骨折，骨折确诊首选检查方法为X线片（A对）。核素扫描（B错）多用于恶性肿瘤骨转移的诊断。关节造影（C错）多用于关节内病变的检查。MRI（D错）、CT（E错）虽对骨折显示的分辨率较高，但价格昂贵，多不作为首选检查。